婴儿基础代谢所需的能量
A. 占总能量50%到60%
B. 占总能量25%到30%
C. 占总能量7%到8%
D. 占总能量10%
E. 占总能量5%

正确答案：A。占总能量50%到60%

解析：基础代谢率是指在清醒安静状态下，维持人体功能的最低能量。婴幼儿期基础代谢所需能量约占总热量60%（A对）。占总能量25%到30%（B错）为生长发育所消耗的能量。占总能量7%到8%（C错）为食物的热力作用所消耗的能量。占总能量10%（D错）为排泄消耗的能量。占总能量5%（E错）为较大儿童食物的热力作用所消耗能量的上限值。